女，48岁。G2P1，渐进性痛经6年，经量增多3年。查体：子宫如妊娠12周大小，质硬，活动受限。药物治疗后症状无缓解。最佳手术治疗方案是
A. 改良广泛子宫切除术
B. 子宫切除术+双附件切除术
C. 广泛子宫切除术
D. 双附件切除术
E. 子宫切除术

正确答案：E。子宫切除术

解析：患者中年女性，G2P1（孕2产1），渐进性痛经6年，经量增多3年。查体：子宫如妊娠12周大小，质硬，活动受限，考虑子宫腺肌病可能性大（子宫均匀增大、月经增多、继发痛经），患者年龄偏大，症状较重，药物治疗无效，首选子宫切除（E对）。